心为“君主之官”的理论基础是
A. 心主血脉
B. 心主神明
C. 心在五行属火
D. 心开窍于舌
E. 以上均非

正确答案：B。心主神明

解析：心主神明，指心具有主宰五脏六腑、形体官窍等生命活动和意识、思维等精神活动的功能。见于《素问·灵兰秘典论》说：“心者，君主之官也，神明出焉”（B对E错），人体的脏腑、经络、形体、官窍，各有不同的生理功能，但都必须在心神的主宰和调节下分工合作，共同完成整体生命活动，心神正常，各脏腑功能协调有序，则身心康泰。心主血脉，是指心气推动血液运行于脉中，流注全身，循环不休，发挥营养和濡润作用，包括主血和主脉两个方面（A错）。心为阳中之太阳，在五行属火（C错）；心开窍于舌，是指舌为心之外候（D错）。